新生儿是指出生至生后不满
A. 7天
B. 14天
C. 28天
D. 30天
E. 60天

正确答案：C。28天

解析：本题考查新生儿的定义。胎儿娩出脐带结扎至28天之前（C对ABDE错）为新生儿，是婴儿的特殊阶段。